属于阳离子型表面活性剂的是
A. 十二烷基苯磺酸钠
B. 十二烷基硫酸钠
C. 聚氧乙烯脱水山梨弹单油酸酯
D. 豆磷脂
E. 洁尔灭

正确答案：E。洁尔灭

解析：本题考查的是表面活性剂的分类。属于阳离子型表面活性剂的是洁尔灭（E对）。表面活性剂按其解离情况不同分为离子型和非离子型两大类，其中离子型表面活性剂又分为阴离子型、阳离子型和两性离子型表面活性剂三类。（1）阴离子型表面活性剂：本类表面活性剂起表面活性作用的是阴离子。主要包括高级脂肪酸盐、硫酸化物以及磺酸化物。①高级脂肪酸盐：又称肥皂类。②硫酸化物：为硫酸化油和高级脂肪醇的硫酸酯类。常用的有：a.硫酸化蓖麻油，俗称土耳其红油；b.高级脂肪醇硫酸酯类，如有十二烷基硫酸钠（B错）（又称月桂醇硫酸钠）。③磺酸化物：主要有脂肪族磺酸化物、烷基芳基磺酸化物、烷基萘磺酸化物等。常用的有：a.脂肪族磺酸化物，如二辛基琥珀酸磺酸钠（商品名“阿洛索-OT”）等；b.烷基芳基磺酸化物，如十二烷基苯磺酸钠（A错）。（2）阳离子型表面活性剂：本类表面活性剂分子结构中起表面活性作用的是阳离子，即分子结构中含有一个五价的氮原子，又称季铵化物。常用的有苯扎氯铵（洁尔灭）、苯扎溴铵（新洁尔灭）等。（3）两性离子型表面活性剂：本类表面活性剂的分子结构中同时含有阴阳离子基团，在不同pH介质中可表现出阴离子或阳离子表面活性剂的性质。①天然的两性离子表面活性剂：主要有豆磷脂（D错）和卵磷脂。②合成的两性离子表面活性剂：本类表面活性剂的阴离子部分主要是羧酸盐，阳离子部分主要是胺盐或季铵盐。（4）非离子型表面活性剂：本类表面活性剂在水中不解离，其分子结构中亲水基团多为甘油、聚乙二醇和山梨醇等多元醇，亲油基团多为长链脂肪酸或长链脂肪醇以及烷基或芳基等，以酯键或醚键相结合。①脱水山梨醇脂肪酸酯：本类表面活性剂系由山梨醇与不同的脂肪酸组成的酯类化合物，商品名为司盘类。②聚氧乙烯脱水山梨醇脂肪酸酯（C错）：又称为聚山梨酯，本类表面活性剂是在司盘类表面活性剂分子结构的剩余羟基上，结合聚氧乙烯基而成的醚类化合物，商品为吐温类。③聚氧乙烯脂肪酸酯：本类表面活性剂系由聚乙二醇与长链脂肪酸缩合而成，商品有卖泽。④聚氧乙烯脂肪醇醚：本类表面活性剂是由聚乙二醇与脂肪醇缩合而成的醚类，商品有苄泽。⑤聚氧乙烯聚氧丙烯共聚物：本类表面活性剂是由聚氧乙烯和聚氧丙烯聚合而成。常用的有普朗尼克类，如普朗尼克F-68。